药物被脂质体包封后的主要特点有
A. 具有靶向性
B. 具有缓释性
C. 具有细胞亲和性与组织相容性
D. 降低药物毒性
E. 提高药物稳定性

正确答案：A、B、C、D、E。具有靶向性；具有缓释性；具有细胞亲和性与组织相容性；降低药物毒性；提高药物稳定性

解析：本题考查脂质体。药物被脂质体包封后具有以下特点：（1）靶向性和淋巴定向性（A对）：药物脂质体静脉注射后，主要聚集在肝、脾、肺、骨髓、淋巴结等网状内皮系统中；（2）缓释和长效性（B对）：药物制成脂质体，减少了肾排泄和代谢而延长了药物在血液和靶组织中的滞留时间，延长了药效；（3）细胞亲和性与组织相容性（C对）：脂质体具有类似生物膜结构的囊泡，有细胞亲和性和组织相容性；（4）降低药物毒性（D对）：药物制备成脂质体后，可大部分选择性的富集于网状内皮系统中，而在心脏、肾脏的累积量较少，降低药物毒性；（5）提高药物稳定性（E对）：脂质体的双层膜可以保护一些不稳定的药物，免受体内外环境的影响，在很大程度上提高了药物的稳定性。